医生与患者的交谈原则应具有
A. 隐蔽性
B. 情绪性
C. 广泛性
D. 指令性
E. 针对性

正确答案：E。针对性

解析：医患沟通技巧常用的沟通技巧包括：尊重和接纳患者，用符合患者文化背景的方式表达对患者的尊重与接纳，双方平等尊重，而不应进行指令性谈话（D错）：聆听与共情能力：明确的沟通目标、围绕沟通目标针对性沟通（E对）：控制沟通中的信息，传递与沟通目标相关的信息，不要偏离了目标，提供与目标无关的信息，不应广泛性谈话（C错）：把握沟通的语言、语调和语速：尽可能符合患者的文化背景：确认彼此是否信任真诚。医生与患者的谈话还应注意选择正确和沟通场所，包括床旁沟通、医生办公室，还有的需要到专门的接待室或心理治疗室，医患沟通不应具有隐蔽性（A错）。在医患交谈中，应保持理性，帮助患者了解病情和治疗情况，尽管应该耐心而认真地聆听患者的陈述，适度对患者的陈述予以恰当的回应，表达理解，但不应进行情绪性谈话（B错）。